女，25岁。2天前咳血痰，今日咯血量达200ml左右。既往身体健康。查体：T37℃，右肩胛下少量细小啰音，心尖部2/6级柔和的收缩期杂音，X线胸片无异常发现。此患者应用止血药物首选
A. 垂体后叶素
B. 6-氨基己酸
C. 立止血（巴曲酶）
D. 氨甲苯酸
E. 卡巴克洛（安络血）

正确答案：A。垂体后叶素

解析：青年女性，突发大量咯血，肺底部细小湿啰音，为典型支气管扩张的表现。早期支扩胸片可无阳性表现。支扩患者反复咯血主要扩张的支气管动脉破裂所致，故止血治疗以血管收缩剂效果最佳。垂体后叶素可收缩小动脉，是大咯血首选止血药物。掌握“支气管扩张”知识点。